患者50岁，因鼻咽癌外院放疗结束后2年，来门诊就诊。检查：全口多个牙齿牙面不同程度龋，部分患牙已成残冠，残根，口内唾液较少，牙面及龈沟软垢多，该患者的诊断为
A. 急性龋
B. 猛性龋
C. 慢性龋
D. 继发龋
E. 平滑面龋

正确答案：B。猛性龋

解析：本题考查猛性龋。鼻咽癌外院放疗，全口多个牙齿牙面不同程度龋，口腔卫生差，因此属于急性龋中的猛性龋（B对A错）。猛性龋是急性龋的一种类型，病程进展较快，多数牙在短期内同时患龋，常见于颌面及颈部接受放射治疗的患者。慢性龋进展慢，龋坏组织染色深，呈黑褐色，病变组织干硬（C错）。继发龋是龋病治疗后，由于充填物边缘或窝洞周围牙体组织破裂，形成菌斑滞留区，或修复材料不密合，产生龋病（D错）。平滑面龋是按照损害的解剖部位分类，除窝沟外牙面发生的龋损均称为平滑面龋（E错）。